老年人口增加可能使
A. 死亡率下降
B. 死亡率增加
C. 婴儿死亡率下降
D. 婴儿死亡率增加
E. 新生儿死亡率增加

正确答案：B。死亡率增加